能大补元气的药是
A. 党参
B. 人参
C. 西洋参
D. 太子参
E. 刺五加

正确答案：B。人参

解析：本题考查的是人参的功效。能大补元气的药是人参（B对）。人参：【功效】大补元气，补脾益肺，生津止渴，安神益智。党参（A错）：【功效】补中益气，生津养血。西洋参（C错）：【功效】补气养阴，清热生津。太子参（D错）：【功效】补气生津。刺五加（E错）：【功效】补气健脾，益肾强腰，养心安神，活血通络。